证见面色萎黄，四肢倦怠，气短少言，心悸不安，头晕眼花，食欲减退，舌淡苔白，脉细弱。治疗的适宜方剂应选
A. 四君子汤
B. 四物汤
C. 八珍汤
D. 归脾汤
E. 当归补血汤

正确答案：C。八珍汤

解析：本证多由素体虚弱，或劳役过度，或病后产后失调，或久病失治，或失血过多所致，气能生血，血能载气，气虚日久常致阴血化生不足，血虚或失血过多致气无所依附。气血两亏，不能上荣于头面，故面色萎黄、头目眼花；肺脾气虚则气短懒言、倦怠乏力、食欲减少；舌质淡、脉细弱，皆为气血虚弱之象，治宜双补气血，用八珍汤治疗。（C对）。四君子汤（A错）的功用为补气健脾，主治脾胃气虚证。四物汤（B错）的功用为补血和血，主治营血虚滞证。当归补血汤（D错）的功用为补气生血，主治血虚发热证。归脾汤（E错）的功用为益气补血，健脾养心，主治心脾气血两虚证；脾不统血证。